联用治疗肺结核
A. 链霉素与异烟肼
B. 链霉素与磺胺嘧啶
C. 青霉素与链霉素
D. 青霉素与磺胺嘧啶
E. 氯霉素与丙种球蛋白

正确答案：A。链霉素与异烟肼

解析：本题考查药物的联合应用。链霉素与异烟肼联用治疗肺结核（A对）。治疗肺结核常以异烟肼（H）、利福平或利福喷丁（R或L）、吡嗪酰胺（Z）3种核心药及乙胺丁醇（E）或链霉素（S）等3～4种药物联用的2HRZE（S）方案。链霉素与磺胺嘧啶（B错）联用治疗布氏杆菌病。青霉素与链霉素（C错）联用治疗亚急性细菌性心内膜炎。青霉素与磺胺嘧啶（D错）一般不联合使用。氯霉素与丙种球蛋白（E错）联用治疗麻疹。